可复性牙髓炎下列哪项是不正确的
A. 是牙髓组织的初期炎症
B. 患牙冷刺激出现瞬间的疼痛反应，刺激去除疼痛消失
C. 叩诊（-）
D. 有自发性疼痛史
E. 电活力测试敏感

正确答案：D。有自发性疼痛史

解析：牙髓炎可分为可复性牙髓炎和不可复性牙髓炎，可复性牙髓炎无自发痛病史，只有不可复性牙髓炎才有自发痛病史，不可复性牙髓炎又包括急性牙髓炎和慢性牙髓炎。掌握“可复性、急慢性牙髓炎”知识点。